患者看不懂文字的含义，但他的视觉和其他语言功能均健全属于
A. 运动失语症
B. 失写症
C. 感觉失语症
D. 失读症
E. 以上均不是

正确答案：D。失读症